能用一针法麻醉的三条神经是
A. 下牙槽神经、舌神经、颊长神经
B. 下牙槽神经、咬肌神经、颊长神经
C. 上牙槽后神经、上牙槽中神经、上牙槽前神经
D. 上牙槽后神经、腭前神经、鼻腭神经
E. 下牙槽神经、咬肌神经、舌神经

正确答案：A。下牙槽神经、舌神经、颊长神经

解析：本题考查下牙槽-舌-颊神经阻滞麻醉。当患者大张口时，下颌支内侧隆突可随下颌骨的运动移向下前，此区域内由前往后有颊长神经、舌神经、下牙槽神经（A对）通过，因为这种特殊的解剖位置，才能用一针法麻醉这三条神经。下牙槽神经、舌神经及颊长神经阻滞麻醉的注射标志点是，患者大张口时，上、下颌牙槽突相距的中点线与翼下颌皱襞外侧3～4mm的交点。咬肌神经的进针标志点是颧弓下缘与下颌切迹中点，与下牙槽神经跟颊长神经的进针点都不同，故无法用一针法同时麻醉下牙槽神经、咬肌神经及颊长神经（B错）。上牙槽后神经麻醉时，以上颌第二磨牙远中颊侧口腔前庭沟作为进针点。上牙槽前神经的麻醉标志点是位于眶下缘中点下方0.5～1cm的眶下孔。上牙槽前神经与上牙槽后神经（C错）的进针点不一样，不能用一针法同时麻醉。腭前神经阻滞麻醉是将麻药注入腭大孔，鼻腭神经阻滞麻醉的麻醉注射点是腭前孔，故下牙槽后神经、腭前神经、鼻腭神经不能用一针法同时麻醉（D错）。咬肌神经的麻醉进针点与下牙槽神经及舌神经的不同，下牙槽神经、咬肌神经及舌神经不能用一针法同时麻醉（E错）。